炮制巴豆常用的方法是
A. 醋炙法
B. 姜炙法
C. 制霜法
D. 油炙法
E. 酒炙法

正确答案：C。制霜法

解析：本题考查的是巴豆的常用炮制方法。炮制巴豆常用的方法是制霜法（C对）。制霜法是指药物经过去油制成松散粉末或析出细小结晶或升华的方法。制霜法根据操作方法的不同分为去油制霜、渗析制霜、升华制霜。去油制霜的目的：①降低毒性，缓和药性。如巴豆，有大毒，泻下作用猛烈，去油制霜后可降低毒性，缓和泻下作用，保证临床用药安全有效。②降低副作用。如柏子仁，其内含柏子仁油，具有滑肠通便之功，体虚便溏患者不宜用，制成霜后，除去了大部分油分，可降低滑肠的副作用。渗析制霜的目的是制造新药，扩大用药品种，增强疗效。如西瓜霜。升华制霜的目的是纯净药物，如砒霜。醋炙法（A错）：将净选或切制后的药物，加入定量米醋拌炒至规定程度的方法。醋炙的主要目的：①降低毒性，缓和药性。如甘遂、京大戟、芫花、商陆等。②引药入肝，增强活血止痛作用。如乳香、没药、三棱、莪术等。③矫臭矫味。如乳香、没药、五灵脂等。姜炙法（B错）：将净选或切制后的药物，加入定量姜汁拌炒的方法。姜炙的目的：①制其寒性，增强和胃止呕作用。如黄连、竹茹等。②缓和副作用，增强疗效。如厚朴等。油炙法（C错）：将净选或切制后的药物，与定量的食用油脂共同加热处理的方法称为油炙法。又称酥炙法。油炙的目的：①增强疗效。如淫羊藿等。②利于粉碎，便于制剂和服用。如豹骨、三七、蛤蚧等。酒炙法（E错）：将净选或切制后的药物，加入定量黄酒拌炒的方法。酒炙的目的：①改变药性，引药上行，如大黄、黄连、黄柏等。②增强活血通络作用，如当归、川芎、桑枝等。③矫臭去腥，如乌梢蛇、蕲蛇、紫河车等。